一侧听辐射损伤将导致
A. 伤侧听力丧失
B. 对侧听力丧失
C. 双侧听力下降，以同侧为主
D. 双侧听力下降，以对侧为主
E. 以上都不是

正确答案：C。双侧听力下降，以同侧为主

解析：因为听觉冲动是双侧传导的，所以一侧听辐射损伤将导致双侧听力下降，以同侧为主（C对）。